急性牙髓炎自发痛时间最明显的特点为
A. 吃饭痛
B. 饭后痛
C. 遇冷痛
D. 遇热痛
E. 夜间痛

正确答案：E。夜间痛

解析：本题考查急性牙髓炎疼痛的性质。急性牙髓炎自发痛时间最明显的特点为夜间痛（E对）。急性牙髓炎（包括慢性牙髓炎急性发作）的主要症状是剧烈疼痛。疼痛的性质具有下列特点：（1）自发性阵发性痛。（2）夜间痛：疼痛往往在夜间发作，或夜间疼痛较白天剧烈。患者常因牙痛难以入眠，或从睡眠中痛醒。（3）温度刺激加剧疼痛：冷、热刺激可激发患牙的剧烈疼痛。若患牙正处于疼痛发作期内，温度刺激可使疼痛加剧。如果牙髓已有化脓或部分坏死，患牙可表现为所谓的“热痛冷缓解”。（4）疼痛不能自行定位：疼痛发作时，患者大多不能明确指出患牙所在，且疼痛呈放散性或牵涉性，常常是沿三叉神经第二支或第三支分布区域放射至患牙同侧的上、下颌牙或头、颞、面、耳等部位，但这种放散痛不会发生到患牙的对侧区域。